上颌窦癌根据肿瘤发生的部位，临床上可出现不同的症状。眶下神经受累可发生面颊部感觉迟钝或麻木，病变部位为
A. 肿瘤发生自上颌窦下壁
B. 肿瘤发生自上颌窦内壁
C. 肿瘤发生自上颌窦后壁
D. 肿瘤发生自上颌窦上壁
E. 肿瘤发生自上颌窦外壁

正确答案：E。肿瘤发生自上颌窦外壁

解析：当肿瘤发生自上颌窦外壁时，则表现为面部及唇颊沟肿胀，以后皮肤破溃、肿瘤外露；眶下神经受累可发生面颊部感觉迟钝或麻木。掌握“中央性颌骨癌及上颌窦癌”知识点。